感染性休克气阴亏竭证的首选方剂是
A. 清瘟败毒饮合小承气汤
B. 生脉散加减
C. 参附汤
D. 参附龙牡救逆汤
E. 独参汤

正确答案：B。生脉散加减

解析：感染性休克气阴亏竭证症状：神志不清，面色苍白，呼吸促而弱，皮肤干燥，尿少口干，四肢厥冷，唇舌干绛，苔少而干，脉细数而无力。治法：益气养阴，救逆固脱，方药：生脉散加减（B对）。感染性休克热毒内闭证症状：高热，烦躁，或精神萎靡，甚则神志昏迷，强直抽搐，喉中痰鸣，胸腹灼热，口渴喜饮，面色苍白，手足厥冷，小便短赤，大便秘结，舌红，苔黄燥，脉数，宜清热解毒，通腑开窍。清瘟败毒饮合小承气汤加减（A错）。阴竭阳脱证症状：神志不清，面色青灰，皮肤紫花或大片瘀斑，体温不升，皮肤湿冷，四肢冰凉过肘膝，汗出如油，呼吸不整，唇紫发青，苔白滑，脉微欲绝，或指纹淡隐。治法：益气回阳，救逆固脱。方药：参附汤或参附龙牡救逆汤加减（CD错）。独参汤补气固脱（E错）。